主动脉瓣狭窄最常见的并发症是
A. 体循环栓塞
B. 右心衰竭
C. 心律失常
D. 心脏性猝死
E. 感染性心内膜炎

正确答案：C。心律失常

解析：主动脉瓣狭窄最常见的并发症是心律失常（C对），10％患者可发生房颤，主动脉钙化累及传导系统可致房室传导阻滞，左心室肥厚、心内膜下心肌缺血或冠状动脉栓塞可致室性心律失常。体循环栓塞少见（A错）。主动脉瓣狭窄主要导致左心房压力升高，使左心房后负荷增大，临床上表现为出现左心衰竭（B错）。心脏性猝死（D错）少见于无症状主动脉瓣狭窄患者。感染性心内膜炎（E错）不常见于主动脉瓣狭窄。